下列糊剂类充填材料中充填根管效果最好的是
A. 氢氧化钙
B. 氧化锌丁香油糊剂
C. 氯仿牙胶
D. 碘仿糊剂
E. 新三锌糊剂

正确答案：A。氢氧化钙

解析：氢氧化钙类根管封闭剂主要含有氢氧化钙制剂，可在根管中缓慢释放，形成高度的碱性环境，导致细菌细胞膜损伤，蛋白质变性和DNA损伤，同时还能中和残留在根管壁上的细菌性产物。主要优点是具有良好的抗菌效果，诱导硬组织形成，促进根尖周组织愈合。掌握“根管充填”知识点。